利用腐殖质化使有机污染物达到无害化的方法是
A. 人工堆肥法
B. 固化法
C. 化学法
D. 焚烧法
E. 填埋法

正确答案：A。人工堆肥法

解析：本题考查人工堆肥法。利用腐殖质化使有机污染物达到无害化的方法是人工堆肥法（A对BCDE错）。